一新生儿暴发脓毒血症，脓汁标本经涂片革兰染色镜检发现葡萄球菌。试问为确定该菌是否有致病力，应检查哪一种酶
A. 血浆凝固酶
B. 触酶
C. DNA酶
D. 尿素酶
E. 卵磷脂酶

正确答案：A。血浆凝固酶

解析：致病性葡萄球菌（金葡菌）鉴定依据：①能产生金黄色色素；②有溶血性；③血浆凝固酶阳性；④能分解甘露醇产酸；⑤耐热核酸酶检测阳性。掌握“葡萄球菌属”知识点。